明显与心理因素相关的躯体疾病是
A. 癔病
B. 反应性精神病
C. 疑病性神经症
D. 疼痛
E. 心身疾病

正确答案：E。心身疾病

解析：心理社会因素在疾病的发生、发展过程中起重要作用的躯体器质性疾病和躯体功能性障碍，称为心身疾病或称心理生理疾病（E对）。癔病（A错）、反应性精神病（B错）、神经症（C错）均是异常心理。疼痛属于感觉的一种（D错）。